能治风湿痹证的药有
A. 辛夷
B. 木贼
C. 羌活
D. 防风
E. 白芷

正确答案：C、D、E。羌活；防风；白芷

解析：本题考查的是羌活、防风与白芷的主治病证。能治风湿痹证的药有羌活（C对）、防风（D对）与白芷（E对）。羌活：【主治病证】（1）风寒表证，表证夹湿，太阳头痛。（2）风寒湿痹。防风：【主治病证】（1）风寒表证，风热表证，表证夹湿。（2）风寒湿痹，风湿疹痒。（3）破伤风，小儿惊风。白芷：【主治病证】（1）外感风寒或表证夹湿兼见头痛鼻塞者。（2）阳明头痛，眉棱骨痛，鼻渊头痛，牙痛。（3）风寒湿痹，寒湿带下。（4）疮疡肿毒。辛夷（A错）：【主治病证】鼻渊头痛，风寒头痛、鼻塞。木贼（B错）：【主治病证】（1）风热目赤，迎风流泪，翳障。（2）血热下血。